Na⁺离子通过离子通道的跨膜转运过程属于
A. 单纯扩散
B. 易化扩散
C. 主动转运
D. 出胞作用
E. 入胞作用

正确答案：B。易化扩散

解析：跨细胞膜的物质转运包括单纯扩散、易化扩散、主动转运、膜泡运输等方式。单纯扩散（A错）主要介导脂溶性物质或少数不带电荷的极性小分子的物质转运，如O₂、CO₂、N₂、NH₃、类固醇激素、乙醇、尿素、甘油、水等；易化扩散包括经通道的易化扩散和经载体的易化扩散两种形式：经通道易化扩散（B对）主要以离子通道的形式（如Na⁺通道、K⁺通道等）进行物质转运，Na⁺离子通过离子通道的跨膜转运过程属于此种方式；经载体的易化扩散主要介导葡萄糖氨基酸等水溶性小分子物质进行顺浓度梯度的跨膜转运；主动转运（C错）包括原发性主动转运和继发性主动转运两种形式，原发性主动转运通常以离子泵的形式（如Na⁺泵、Ca²⁺泵、H⁺泵等）转运各种带电离子，但其通过膜蛋白转运且为消耗能量的逆浓度运输；膜泡运输包括出胞作用（D错）和入胞作用（E错）两种形式，主要介导大分子和颗粒物质的跨膜转运。